药物随胆汁排入十二指肠可经小肠被重吸收称为
A. 简单扩散
B. 主动转运
C. 首过消除
D. 肝肠循环
E. 易化扩散

正确答案：D。肝肠循环

解析：本题考查肝肠循环。肝肠循环（D对）又称肠肝循环，是指随胆汁排入十二指肠的药物或其代谢物，在肠道中重新被吸收，经门静脉返回肝脏，重新进入血液循环的现象；简单扩散（A错）为顺浓度梯度扩散；主动转运（B错）为药物借助载体或酶促系统，逆浓度梯度的转运过程；首过消除（C错）为口服药物进入血液循环前的降解或失活；易化扩散（E错）为借助载体的被动运输。